前牙金瓷冠切端磨除量一般为
A. 1.0mm
B. 2.0mm
C. 2.5mm
D. 3.0mm
E. 3.5mm

正确答案：B。2.0mm

解析：前牙切端应至少预备出1.5～2.0mm的间隙，并保证在正中（牙合）及非正中（牙合）时均有足够的间隙以保证金属与瓷的厚度，并防止切端透出金属色或遮色层外露。掌握“烤瓷熔附金属冠”知识点。